狂证火盛伤阴证，其治法是
A. 活血化瘀，涤痰镇静
B. 安神定志，祛痰降火
C. 降火豁痰，安神宁心
D. 镇心涤痰，泻肝清火
E. 育阴潜阳，交通心肾

正确答案：E。育阴潜阳，交通心肾

解析：狂证火盛伤阴是因心肝郁火，或阳明腑热久羁，耗津伤液，心肾失调，阴虚火旺，神明受扰所致，此时痰与瘀已经不是病机的要点（ABCD错），当育阴潜阳，交通心肾（E对）。